下列关于氨基酸残基的化学修饰除外的是
A. 糖基化
B. 羟基化
C. 甲基化
D. 碱基化
E. 磷酸化

正确答案：D。碱基化

解析：氨基酸残基的化学修饰：蛋白质分子中某些氨基酸残基的侧链可进行翻译后的共价修饰。由于这些共价修饰，组成蛋白质的氨基酸种类显著增加。这些化学修饰有：①糖基化；②羟基化；③甲基化；④磷酸化；⑤二硫键形成；⑥亲脂性修饰。掌握“蛋白质的生物合成”知识点。